治疗胁痛瘀血停着证，应首选
A. 龙胆泻肝汤
B. 柴胡疏肝散
C. 旋覆花汤
D. —贯煎
E. 茵陈蒿汤

正确答案：C。旋覆花汤

解析：龙胆泻肝汤功能清理肝胆湿热，为胁痛肝胆湿热证的选方（A错）。柴胡疏肝散功能疏肝解郁，理气止痛，为胁痛肝郁气滞证的选方（B错）。胁痛瘀血停着即瘀血阻络证，为瘀血停滞，肝络痹阻所致，治宜祛瘀通络，方选旋覆花汤，亦可选血府逐瘀汤或复元活血汤（C对）。一贯煎功能滋阴柔肝止痛，为胁痛肝络失养证的选方（D错）。茵陈蒿汤功能清热利湿退黄，主治湿热黄疸（E错）。